慢性中毒发生的基础是
A. 毒物的剂量
B. 毒物的作用时间
C. 毒物的蓄积作用
D. 毒物的选择作用
E. 个体差异

正确答案：C。毒物的蓄积作用